确诊宫颈癌简便易行的筛查方法是
A. 阴道镜检查
B. CT检查
C. 碘试验
D. 宫颈刮片细胞学检查
E. 检查宫颈组织硬、脆、触之出血

正确答案：D。宫颈刮片细胞学检查

解析：宫颈刮片细胞学检查：此法是简便易行的子宫颈癌筛查方法。有传统的巴氏涂片和现代的液基细胞学制片方法。以往采用巴氏五级分类法报告，目前主张采用TBS报告系统。掌握“宫颈癌”知识点。